用高效液相色谱鉴别药物时应选用的色谱法参数是
A. 保留时间
B. 峰面积
C. 峰宽
D. 半峰宽
E. 标准差

正确答案：A。保留时间

解析：本题考查高效液相色谱法。用高效液相色谱鉴别药物时应选用的色谱法参数是保留时间（A对）。HPLC法一般采用对照品（标准品）比较法，要求供试品溶液中色谱峰的保留时间（tR）与对照品一致。每一个组分的色谱峰可用三项参数说明：峰高或峰面积（用于定量）；峰位（用保留值表示，用于定性）；峰宽（用于衡量柱效）（CD错）。鉴别属于定性分析，选用的色谱参数是保留时间；杂质限量需要测定检测限，属于定量分析，选用的色谱参数是峰面积（B错）。药物含量属于定量分析，选用的色谱参数是峰面积。标准差（E错）常作为精密度验证指标之一。